下列精神分裂症症状中，属于阳性症状的是
A. 思维贫乏
B. 病理性象征性思维
C. 情感淡漠
D. 意志减退
E. 情感平淡

正确答案：B。病理性象征性思维